患儿发热，头痛，鼻塞，流脓涕，咳嗽，喷嚏，咽红，口干而渴，舌红苔薄白，脉浮数。其治法是
A. 疏风肃肺
B. 疏风宣肺
C. 辛凉解表
D. 辛温解表
E. 清暑解表

正确答案：C。辛凉解表

解析：患儿以发热、鼻塞流涕、喷嚏、咳嗽为主要临床表现，当属感冒，其外感风热，侵犯上焦，肺气不宣，故见发热，头痛，鼻塞，流脓涕，咳嗽，喷嚏，咽红，口干而渴，舌脉亦为风热之象，治当辛凉解表（C对）。疏风肃肺用于风热咳嗽，症见咳嗽不爽，痰黄黏稠，不易咯出，口渴咽痛，鼻流浊涕（A错）。疏风宣肺可用于风寒咳嗽，症见咳嗽频作、声重，咽痒，痰白清稀，鼻塞流涕，恶寒无汗，发热头痛（B错）。辛温解表用于风寒感冒，症见发热，恶寒，无汗，头痛，鼻流清涕，喷嚏，咳嗽，咽部不红肿（D错）。清暑解表用于暑邪感冒，症见发热，无汗或汗出热不解，头晕、头痛，鼻塞，身重困倦，胸闷，泛恶，食欲不振，或有呕吐、泄泻，小便短黄（E错）。